某患者血气分析显示：PaCO₂＞45mmHg，PaO₂＜60mmHg。对该结果发生机制的解释最正确的是
A. 肺动/静脉分流
B. 肺脏生理死腔减少
C. 弥散功能障碍
D. 限制性通气功能障碍
E. 肺泡通气量下降

正确答案：E。肺泡通气量下降

解析：该患者PaCO₂＞45mmHg，PaO₂＜60mmHg（正常值80-100mmHg）可知此患者为二型呼衰，其机制是阻塞性通气功能障碍（E对AD错）。肺脏生理死腔减少（B错）时通气/血流比值减小，气体交换效率降低，但主要导致低氧血症。弥散障碍（C错）时常以低氧血症为主。